下列各项，不属温热药的作用的是
A. 温里散寒
B. 滋阴除蒸
C. 暖肝散结
D. 引火归元
E. 回阳救逆

正确答案：B。滋阴除蒸

解析：温热药能温里散寒如干姜（A对）、暖肝散结如吴茱萸（C对）、引火归元如肉桂（D对），回阳救逆如附子（E对），滋阴除蒸是滋阴药物的作用（B错为本题正确答案）。